下列关于妊娠期子宫的叙述，错误的是
A. 子宫颈紫蓝色，质软
B. 妊娠足月子宫容量约5000ml
C. 早孕40多天，可扪及子宫增大变软
D. 妊娠足月子宫较正常子宫容量增加100倍
E. 妊娠足月子宫较正常子宫重量增加20倍

正确答案：D。妊娠足月子宫较正常子宫容量增加100倍

解析：妊娠时子宫腔容量由非孕时的 5ml, 增至足月时约 5000ml（B对）, 增加 1000倍而非100倍（D错为本题正确答案）”。